牙周膜中来源于残留的上皮细胞成分是
A. 成纤维细胞
B. 上皮剩余
C. 成骨细胞
D. 成牙骨质细胞
E. 间充质细胞

正确答案：B。上皮剩余

解析：上皮剩余：在牙周膜中，邻近牙根表面的纤维间隙中可见到小的上皮条索或上皮团，与牙根表面平行排列，即上皮剩余，也称Malassez上皮剩余。这是牙根发育期间上皮根鞘残留下来的上皮细胞。掌握“牙周膜”知识点。